反酸、烧心、嗳气2个月，胃镜检查食管黏膜未见明显异常，最可能的疾病是
A. 非糜烂性胃食管反流病
B. 胃溃疡
C. 慢性胃炎
D. 胆囊炎
E. 消化性溃疡

正确答案：A。非糜烂性胃食管反流病

解析：患者出现反酸、烧心、嗳气2个月（为反流性食管炎的临床表现），胃镜检查食管黏膜未见明显异常（排除食管癌、胃癌的器质性疾病），最可能的疾病为非糜烂性胃食管返流病（A对）；消化性溃疡（E错）多为胃溃疡（B错）和十二指肠溃疡，前者表现为常表现为餐后痛，后者表现为夜间痛或饥饿痛；慢性胃炎（C错），多数病人无明显症状，多为中上腹不适、饱胀、钝痛、烧灼痛等表现；胆囊炎（D错），多表现为持续性右上腹疼痛，可向右肩或背部放射。